有关DNA碱基组成规律的叙述，错误的是
A. 适用于不同种属
B. 嘌呤与嘧啶含量相等
C. 与遗传特性有关
D. 主要由腺嘌呤组成
E. 不受年龄与营养状态影响

正确答案：D。主要由腺嘌呤组成

解析：在DNA的碱基中，嘌呤包括腺嘌呤（A）和鸟嘌呤（G），嘧啶包括胸腺嘧啶（T）和胞嘧啶（C），由于腺嘌呤和胸腺嘧啶相等，即A=T，鸟嘌呤和胞嘧啶相等，即G=C，所以A+G=T+C，也即嘌呤和嘧啶含量相等（B对）。由以上也可得知（D错，为本题正确选项）。由于同一个体不同器官或不同组织的DNA具有相同的碱基组成，这符合遗传规律，可以得知DNA碱基组成的规律是与遗传有关的（C对）。同样由于DNA的稳定性，其碱基组分不随年龄营养状态环境而变化，随环境变化的是RNA（E对）